患者，女，55岁，1个月前诊断为高血压，服药控制血压尚可。但近2周无明显诱因出现刺激性干咳，考虑为药物不良反应所致，可能引起上述症状的药物是
A. 氢氯噻嗪
B. 福辛普利
C. 氨氯地平
D. 伊伐布雷定
E. 比索洛尔

正确答案：B。福辛普利

解析：本题考查口服降压药的不良反应。血管紧张素转换酶抑制剂（ACEI类，如福辛普利）（B对）易导致刺激性干咳，刺激性干咳与肺血管床内的缓激肽和/或前列腺素、P物质聚积有关。